按五行生克规律，五味入五脏，多食苦则伤
A. 心
B. 肝
C. 脾
D. 肺
E. 肾

正确答案：A。心

解析：五味，指酸、苦、甘、辛、咸对应五脏肝、心、脾、肺、肾。多食苦则伤心（A对）。多食酸则伤肝（B错）。多食甘则伤脾（C错）。多食辛则伤肺（D错）。多食咸则伤肾（E错）。